《中国药典》（一部）规定，要进行浸出物测定的药材有
A. 石韦
B. 蓼大青叶
C. 大青叶
D. 枇杷叶
E. 罗布麻叶

正确答案：A、B、C、E。石韦；蓼大青叶；大青叶；罗布麻叶

解析：本题考查的是浸出物测定的药材。《中国药典》（一部）规定，要进行浸出物测定的药材有石韦（A对）、蓼大青叶（B对）、大青叶（C对）、罗布麻叶（E对）。石韦【浸出物】按醇溶性浸出物热浸法测定，稀乙醇浸出物不得少于18.0%。大青叶【浸出物】按醇溶性浸出物热浸法测定，乙醇浸出物不得少于16.0%。罗布麻叶【浸出物】按醇溶性浸出物热浸法测定，用75%乙醇作溶剂，不得少于20.0%